女，50岁，近半年左手活动不灵，看电视时出现每秒4～6次的节律性颤动，随意运动时减轻，入睡后完全消失，患者的颤动症状为
A. 意向性颤动
B. 动作性颤动
C. 舞蹈样动作
D. 手足徐动症
E. 静止性颤动

正确答案：E。静止性颤动

解析：中老年患者，手指有节律的抖动，每秒约4-6次，安静时出现，活动时减轻，睡眠时消失，属于静止性震颤（E对），常见于帕金森病。意向性震颤（A错）属于动作性震颤，动作性震颤的特点为特定姿势或运动时出现，幅度大。舞蹈样动作（C错）为肢体不规则、无节律和无目的的不自主运动，表现为耸肩转颈、伸臂、抬臂、摆手和手指伸屈等动作。手足徐动症（D错）表现为由于上肢远端的游走性肌张力增高或降低，而产生手腕及手指做缓慢交替性的伸屈动作。